女，16岁。心慌，多汗低热1周，查体：甲状腺左叶肿大触痛质硬。血FT₃及FT₄升高，血沉80mm/h应首先考虑
A. 甲状腺左叶出血
B. 自主性功能亢进性甲状腺腺瘤
C. Graves病
D. 亚急性甲状腺炎
E. 桥本甲状腺炎

正确答案：D。亚急性甲状腺炎

解析：青年女性患者，心慌、多汗、低热1周，体格检查甲状腺左叶肿大，且质硬有触痛（亚急性甲状腺炎的典型触诊表现），血FT₃及FT₄升高，血沉80mm/h（正常成年女性血沉为0～20mm/h，血沉增快多提示急性炎症期），最可能的诊断为亚急性甲状腺炎（D对）。亚急性甲状腺炎是一种与病毒感染相关的自限性甲状腺炎，起病前1～3周常有病毒感染的症状，甲状腺区发生明显疼痛，可放射至耳部，可有全身不适、食欲减退、肌肉疼痛、发热、心动过速等急性炎症期及甲状腺毒症的表现，甲状腺轻中度肿大、有时单侧肿大明显、质地较硬、触痛显著，其实验室检查可出现特征性的血清甲状腺激素水平和甲状腺摄碘能力的“分离现象”即血清T₃、T₄升高而¹³¹I摄取率减低。甲状腺左叶出血（A错）多见于甲状腺囊肿，急性期可有疼痛和甲状腺肿大，但不会出现心慌、低热、出汗1周，且甲状腺质地较软。自主性功能亢进性甲状腺腺瘤（B错）可有明显的甲亢症状，甲状腺多为结节性肿大，无触痛。Graves病（C错）多有不同程度的甲状腺肿，多呈弥漫性甲状腺肿大，质地中等，无压痛。桥本甲状腺炎（E错）表现为弥漫性甲状腺肿大，质地坚硬，无触痛，甲状腺功能正常或减低。